传染源是指体内有病原体繁殖，而且能排出病原体的
A. 病人，不包括带菌者
B. 受污染物品
C. 带菌者，不包括病人
D. 人或动物
E. 患病物，不包括携带病原体的动物

正确答案：D。人或动物

解析：本题考查传染源的概念。传染源是指体内有病原体生长、繁殖，并能排出病原体的人和动物（D对ABCE错）。